影剧院场次的空场间隔时间不应少于多少分钟，其中空场时间不少于多少分钟
A. 30，20
B. 20，10
C. 30，10
D. 60，30
E. 60，10

正确答案：C。30，10

解析：本题考查影剧院场次的间隔时间和空场时间。影剧院场次的间隔时间不应少于30分钟，其中空场时间不少于10分钟（C对ABDE错），换场时应加强通风
换气。